既能退虚热，又利尿通淋的药是
A. 青黛
B. 白薇
C. 连翘
D. 玄参
E. 紫草

正确答案：B。白薇

解析：本题考查的是白薇的功效。既能退虚热，又利尿通淋的药是白薇（B对）。白薇：【功效】退虚热，凉血清热，利尿通淋，解毒疗疮。青黛（A错）：【功效】清热解毒，凉血消斑，定惊。连翘（C错）：【功效】清热解毒，疏散风热，消肿散结，利尿。玄参（D错）：【功效】清热凉血，滋阴降火，解毒散结，润肠。紫草（E错）：【功效】凉血活血，解毒透疹。